符合肝硬化门静脉高压的腹腔积液特点
A. 血清腹水白蛋白梯度＞11g/L
B. AFP升高
C. ADA升高
D. 白细胞300×10⁶/L，中性粒细胞居多
E. 找到异型细胞

正确答案：A。血清腹水白蛋白梯度＞11g/L

解析：腹腔积液形成的机制涉及：1、门静脉高压，腹腔内脏血管床静水压增高，组织液回吸收减少而涌入腹腔，是腹腔积液形成的决定性因素；2、低清蛋白血症，清蛋白低于30g/L时，血浆胶体渗透压降低，毛细血管内液体涌入腹腔或组织间隙（A对）。